大剂量具有抗雄激素作用，可用于子宮内膜癌或肾癌的药物是
A. 地屈孕酮
B. 屈螺酮
C. 甲羟孕酮
D. 环丙孕酮
E. 左炔诺孕酮

正确答案：D。环丙孕酮

解析：本题考查环丙孕酮。大剂量具有抗雄激素作用，可用于子宮内膜癌或肾癌的药物是环丙孕酮（D对）。地屈孕酮（A错）用于治疗内源性孕酮不足引起的疾病，如痛经、子宫内膜异位症、继发性闭经、孕激素缺乏所致先兆性流产或习惯性流产等。屈螺酮（B错）具有抗盐皮质激素和抗雄激素的作用。甲羟孕酮（C错）主要用于治疗肾癌、乳腺癌、子宫内膜癌、前列腺癌等病症。左炔诺孕酮（E错）可以抑制排卵并阻止孕卵着床。